下列物质属第二信使的有
A. cAMP
B. cGMP
C. 生长因子
D. 转化因子
E. NO

正确答案：A、B、E。cAMP；cGMP；NO